女，25岁。右下6全冠戴入后不久出现龈组织红肿疼痛，最不可能出现的原因是
A. 垂直型食物嵌塞
B. 水平型食物嵌塞
C. 修复体边缘过长
D. 创伤（牙合）
E. 修复体轴面凸度恢复不正确

正确答案：D。创伤（牙合）

解析：全冠戴入后，食物嵌塞可能会引起龈组织红肿。轴面凸度恢复不良，比如外展隙过大，也容易引起食物嵌塞导致牙龈红肿。修复体边缘过长可能会压迫龈组织，且边缘不密合，形成悬突，容易引起牙龈炎导致牙龈红肿。所以ABCE四个选项都可能会导致龈组织红肿。而创伤（牙合）容易引起牙齿出现咬合痛，不会出现龈组织红肿疼痛，是最不可能的原因。掌握“修复体戴入后的问题及处理”知识点。